牛蒡子的炮制宜用
A. 炒黄法
B. 炒焦法
C. 炒炭法
D. 麸炒法
E. 米炒法

正确答案：A。炒黄法

解析：本题考查的是牛蒡子的炮制方法。牛蒡子的炮制宜用炒黄法（A对）。牛蒡子：【炮制方法】处方用名有牛蒡子、大力子、炒牛蒡子、炒大力子。①牛蒡子：取原药材，除去杂质，洗净，干燥。用时捣碎。②炒牛蒡子：取净牛蒡子，置炒制容器内，用文火加热，炒至略鼓起，微有香气，断面浅色时，取出。用时捣碎。炒焦法（B错）是将净选或切制后的药物，置炒制容器内，用中火或武火加热，炒至药物表面呈焦黄或焦褐色，内部颜色加深，并具有焦香气味。炒焦的目的：主要是增强药物消食健脾的功效或减少药物的刺激性，如山楂、栀子等。炒炭法（C错）是将净选或切制后的药物，置炒制容器内，用武火或中火加热，炒至药物表面焦黑色或焦褐色，内部呈棕褐色或棕黄色。炒炭的目的：经炒炭炮制后可使药物增强或产生止血、止泻作用。麸炒法（D错）是将净制或切制后的药物用麦麸熏炒的方法。麸炒的目的：①增强疗效，如山药、白术、芡实等。②缓和药性，如苍术、枳实、薏苡仁等。③矫臭矫味，如僵蚕等。米炒法（E错）是将净制或切制后的药物与米同炒的方法。米炒的目的：①增强药物的健脾止泻作用，如党参。②降低药物的毒性，如红娘子、斑蝥。③矫正不良气味，如昆虫类药物。